关于心血管疾病，所有我们仅知道几个危险因素，如吸烟、高血压、高血脂，但是据此就可以预防绝大部分心血管病例。依据此事实，以下推论错误的是
A. 这些因素都是心血管疾病的组分病因
B. 这些因素都不是心血管疾病的充分病因
C. 这些因素作为组分病因参与了心血管疾病最主要的充分病因
D. 阻断这些因素，就阻断了这些因素参与的所有充分病因
E. 这些因素一起组成了心血管疾病的必要病因

正确答案：E。这些因素一起组成了心血管疾病的必要病因

解析：本题考查必要病因。必要病因是一个疾病发生必需的组分病因，是该疾病所有充分病因都需要的组分病因；若该病因不存在，疾病就不会发生，因此所有病人都具有该病因。吸烟、高血压、高血脂这几个危险因素并不都是所有的病人都具备这些病因，故这些因素并不是心血管疾病的必要病因（E错，为本题正确答案）。吸烟、高血压、高血脂这几个危险因素都是心血管疾病的组分病因（A对），但不是心血管疾病的充分病因（B对）。这些因素作为组分病因参与了心血管疾病最主要的充分病因（C对），阻断这些因素，就阻断了这些因素参与的所有充分病因（D对）。